患者出现神志淡漠或神志不清，面色苍白或青灰，冷汗淋漓，四肢厥冷，息促气微，体温不升，舌淡，脉微欲绝或不能触及，治疗应首选的方剂是
A. 大承气汤
B. 生脉散
C. 四逆汤
D. 三甲复脉汤加减
E. 炙甘草汤

正确答案：C。四逆汤

解析：心肌病心阳虚脱证的症状：心阳虚衰，推动、温运无力，心动失常，故见神志淡漠或神志不清；胸阳不展，故见息促气微；阳虚卫外不固，故见冷汗淋漓，精神萎靡；温运乏力，血行不畅，故见面色苍白或青灰，脉细微欲绝或不能触及；阳虚温煦失职，故见四肢厥冷，体温不升；阳虚水湿不化，故见舌淡。治法：回阳固脱。方药：四逆汤合参附龙牡汤加味（C对）。大承气汤峻下热结，治疗阳明腑实、热结旁流、里热实证之热厥、痉病、发狂（A错）。生脉散益气生津，敛阴止汗，治疗温热、暑热伤气耗阴证，久咳肺虚气阴两伤证（B错）。三甲复脉汤滋阴清热，潜阳熄风，治疗下焦温病，热深厥甚，脉细促，心中憺憺大动，甚则心中痛者（D错）。炙甘草汤滋阴养血，益气温阳，复脉定悸，治疗阴血不足阳气虚弱，虚劳肺痿证（E错）。